维系蛋白质二级结构稳定的主要化学键是
A. 盐键
B. 氢键
C. 疏水作用
D. 肽键
E. 二硫键

正确答案：B。氢键